阵发性室上性心动过速并发变异型心绞痛，宜采用下述何种药物治疗
A. 维拉帕米
B. 利多卡因
C. 普鲁卡因胺
D. 奎尼丁
E. 普萘洛尔

正确答案：A。维拉帕米